可形成中介体的细菌结构是
A. 细胞壁
B. 菌毛
C. 鞭毛
D. 质粒
E. 细胞膜

正确答案：E。细胞膜

解析：细胞膜参与细菌结构（如肽聚糖、鞭毛和荚膜等）的生物合成，形成中介体（参与细菌分裂繁殖）等功能。掌握“细菌的大小、形态和基本结构”知识点。